用银汞合金充填的患牙，如若对颌牙为铸造金属全冠，咬合接触时出现痛觉，应考虑
A. 金属微电流
B. 牙髓疾病
C. 继发龋
D. 根尖周炎
E. 充填体悬突

正确答案：A。金属微电流

解析：本题考查修复后可能出现的问题。用银汞合金充填的患牙，如若对颌牙为铸造金属全冠，咬合接触时出现痛觉，应考虑金属微电流（A对）。用银汞合金充填的患牙，如若对颌牙为异种金属修复体，咬合接触时出现电击样刺痛，脱离接触或反复咬合多次后疼痛消失，应考虑是否与异种金属间产生电流作用有关。